完整处方的组成包括
A. 处方标题
B. 处方前记
C. 处方正文
D. 处方后记
E. 处方附记

正确答案：B、C、D。处方前记；处方正文；处方后记

解析：本题考查处方的组成。完整的处方由三部分组成，分别是处方前记（B对）、处方正文（C对）和处方后记（D对）。前记包括医疗、预防、保健机构名称，费别（支付与报销类别），患者姓名、性别、年龄，门诊或住院病历号、科别或病区和床位号，临床诊断、开具日期等。后记有医师签名或加盖专用签章，药品金额以及审核、调配、核对、发药的药学专业技术人员签名或加盖专用签章。